根据蒙医传统用药的“服药十则”，补养药的服用时间是
A. 食前服
B. 食间服
C. 睡前服
D. 空腹服
E. 夹食服

正确答案：A。食前服

解析：本题考查的是蒙药用药方法。根据蒙医传统用药的“服药十则”，补养药的服用时间是食前服（A对）。蒙医有口服、外敷、外涂、洗、泡、漱、熏、吸、喷、灌肠、腔内滴等用药方法。其中口服最为多用，是蒙医传统用药的主要途径。蒙医传统用药的“服药十则”是：治疗寒证及驱虫药，早晨空腹服（D错）；补养或下清“赫依”（通便、通经）药，食前服；上行“赫依”（理气）药，食间服（B错）；司命“赫依”（镇静）药，食药交替服；平喘、祛痰或催吐药，不定期服；止逆药，与食混服；止噎或开胃药，夹食服（E错）（饭前饭后各一半）；治“巴达干”病或毒剧麻药及催眠药，睡前服（C错）。